不是由主动脉瓣病变引起主动脉瓣关闭不全的疾病是
A. 感染性心内膜炎
B. 风湿性心脏病
C. 先天性二叶主动脉瓣
D. 梅毒性主动脉炎
E. 主动脉瓣黏液样变性

正确答案：D。梅毒性主动脉炎

解析：梅毒性主动脉炎（D错，为本题正确答案）可破坏主动脉中层，致主动脉根部扩张，30%发生主动脉瓣关闭不全，不是引起主动脉瓣病变而导致主动脉瓣关闭不全。由主动脉瓣病变引起主动脉瓣关闭不全的疾病包括感染性心内膜炎（A对）、风湿性心脏病（B对）、先天性二叶式主动脉瓣（C对）、主动脉瓣黏液样变性（E对）。